与牙周病有关的全身疾病是
A. 微生物
B. 吸烟
C. 糖尿病
D. 刷牙
E. 牙石

正确答案：C。糖尿病

解析：牙周炎的发生、发展均与全身状况密切相关，同样，牙周炎的预后也受全身因素的影响。如糖尿病、营养不良或免疫功能异常等。这类患者的预后与全身疾病能否控制或纠正有着密切的关系。掌握“慢性牙周炎的病因，表现诊断及预后”知识点。